从天然产物中发现的抗菌药物有
A. 盐酸小檗碱
B. 盐酸林可霉素
C. 甲硝唑
D. 磷霉素
E. 利奈唑胺

正确答案：A、B、D。盐酸小檗碱；盐酸林可霉素；磷霉素

解析：本题考查抗菌药物。从天然产物中发现的抗菌药物有盐酸小檗碱（A对）、林可霉素（B对）、磷霉素（D对）。利奈唑胺（E错）和甲硝唑（C错）是人工合成的。